盆内脏神经属于
A. 副交感神经与脊神经混合的神经
B. 副交感与交感神经混合的神经
C. 副交感神经
D. 交感神经
E. 副交感、交感和骶神经混合的神经

正确答案：C。副交感神经

解析：节前纤维由脊髓骶部第2-4节段的骶副交感核发出，随骶神经出骶前孔，而后从骶神经分出组成盆内脏神经加入盆丛，随盆丛分支分布到盆腔脏器（C对）。